男，54岁。渐进性水肿半年，无糖尿病病史，Cr78μmol，C₃正常，ANA（-），蛋白尿（++），血压150/90mmHg。肾脏病理类型
A. 急进性肾小球肾炎
B. 膜性肾病
C. 脂性肾病
D. 膜增生性肾小球肾炎
E. IgA肾病

正确答案：B。膜性肾病

解析：中老年男性患者（膜性肾病的好发人群），渐进性水肿半年，无糖尿病病史，Cr（血肌酐值）78μmol/L（正常值（男）44～133μmol/L），蛋白尿强阳性，血压150/90mmHg（1级高血压）。患者出现水肿、蛋白尿、高血压，病程迁延达半年，考虑慢性肾小球肾炎的可能性大。慢性肾炎可见于多种肾脏病理类型，其中好发于中老年男性的病理类型是膜性肾病，因此首选病理类型应为膜性肾病（B对）。急进性肾小球肾炎（A错）起病急，经常在短期内发生肾功能减退（P467），该患者病程已达半年且无肾功能受损表现，可排除该诊断。脂性肾病（C错）好发于儿童（P471），且不是慢性肾炎的病理类型，可排除。膜增生性肾小球肾炎（D错）即系膜毛细血管性肾小球肾炎，大部分病例C3值持续性降低（P473），该患者C3正常，故不作为首选。IgA肾病（E错）好发于青少年男性，起病前多有感染，血尿为最常见的症状（P469），该患者中老年男性，无前驱感染史无血尿，所以不作为首选。